眶下孔是何神经阻滞麻醉的有效注射部位
A. 鼻腭神经
B. 腭中神经
C. 腭后神经
D. 眶下神经
E. 上牙槽后神经

正确答案：D。眶下神经

解析：上颌体前外面有眶下孔、尖牙窝，眶下孔位于眶下缘中点下方约0.5cm处，孔内有眶下神经、血管通过，是眶下神经阻滞麻醉的有效注射部位，眶下孔向后、上、外方通入眶下管，尖牙窝一般位于前磨牙根尖的上方。掌握“面部表面解剖”知识点。